50岁女性，车祸3小时入院，诊断：骨盆骨折，左股骨干骨折及左胫骨开放性骨折，首先应密切观察的是哪种并发症
A. 休克
B. 泌尿系感染
C. 创口感染
D. 疼痛
E. 坠积性肺炎

正确答案：A。休克

解析：患者车祸后入院，诊断为骨盆骨折，左股骨干骨折及左胫骨开放性骨折，属多发性严重骨折（骨盆骨折、股骨骨折和多发性骨折其出血量大者可达2000ml以上），此时特别容易引起大出血而导致休克，因此，应首先密切观察并发症是休克（A对）。疼痛（D错）是骨折的一般表现。泌尿性感染（B错）、创口感染（C错）和坠积性肺炎（E错）均是骨折的晚期并发症。